链霉素抑制结核菌的机制是
A. 抑制其DNA聚合酶
B. 抑制其转肽酶
C. 抑制其RNA聚合酶
D. 与核糖体小亚基结合并改变其构象
E. 抑制其拓扑异构酶

正确答案：D。与核糖体小亚基结合并改变其构象